气喘咳嗽，皮肤蒸热，日晡尤甚，舌红苔黄，脉细数，治疗应首先的方剂是
A. 桑菊饮
B. 泻白散
C. 桑杏汤
D. 清燥救肺汤
E. 百合固金汤

正确答案：B。泻白散

解析：以气喘咳嗽为主症，提示病位在肺，当治以宣肺止咳平喘；肺合皮毛，故皮肤蒸热多是由肺热外蒸于皮毛所致；日晡尤甚，舌红苔黄，脉象细数，提示此热非外感所致，而是伏热渐伤阴分，故当予以清泻肺中郁热，平喘止咳，应首选泻白散（B对），桑白皮甘寒性降，专入肺经，清泻肺热，平喘止咳，为君药；臣以甘寒入肺之地骨皮，可助君药清降肺中伏火；炙甘草、粳米养胃和中以扶肺气，共为佐使。桑菊饮功用为疏风清热，宣肺止咳，主治风温初起，表热轻证（A错）。桑杏汤功用为清宣温燥，润肺止咳，主治外感温燥证（C错）。清燥救肺汤功用为清燥润肺，养阴益气，主治温燥伤肺，气阴两伤证（D错）。百合固金汤功用为滋养肺肾，止咳化痰，主治肺肾阴亏，虚火上炎证（E错）。